女性，28岁，牙龈刷牙出血2年。检查：全口牙石（+），牙龈缘轻度红肿，探诊出血，探诊深度2mm，未见牙龈退缩。最可能的诊断是
A. 慢性龈炎
B. 妊娠期龈炎
C. 坏死性龈炎
D. 慢性牙周炎
E. 侵袭性牙周炎

正确答案：A。慢性龈炎

解析：本题考查慢性龈炎。考查的知识点是慢性龈炎的诊断和鉴别诊断。临床表现符合慢性龈炎（A对）。